药品经营企业质量管理部门的主要职责是
A. 执行质量否决权制度
B. 协助经理管理本企业经营药品的质量管理、验收和检测工作
C. 负责领导质量验收组业务工作
D. 负责企业关于药品质量管理方面规章制度的督促执行
E. 负责处理药品质量查询

正确答案：B。协助经理管理本企业经营药品的质量管理、验收和检测工作

解析：本题考查药品经营企业质量管理部门的主要职责。药品经营企业质量管理部门的主要职责是协助经理管理本企业经营药品的质量管理、验收和检测工作（B对）。质量管理部门应当履行的职责包括：督促相关部门和岗位人员执行药品管理的法律法规及药品GSP；组织制订质量管理体系文件，并指导、监督文件的执行；负责对供货单位和购货单位的合法性、购进药品的合法性以及供货单位销售人员、购货单位采购人员的合法资格进行审核，并根据审核内容的变化进行动态管理；负责质量信息的收集和管理，并建立药品质量档案；负责药品的验收，指导并监督药品采购、储存、养护、销售、退货、运输等环节的质量管理工作；负责不合格药品的确认，对不合格药品的处理过程实施监督；负责药品质量投诉和质量事故的调查、处理及报告；负责假劣药品的报告；负责药品质量查询；负责指导设定计算机系统质量控制功能；负责计算机系统操作权限的审核和质量管理基础数据的建立及更新；组织验证、校准相关设施设备；负责药品召回的管理；负责药品不良反应的报告；组织质量管理体系的内审和风险评估；组织对药品供货单位及购货单位质量管理体系和服务质量的考察和评价；组织对被委托运输的承运方运输条件和质量保障能力的审查；协助开展质量管理教育和培训等。